男，46岁，吸烟史20年。发热2周（37.5～38℃），右胸疼痛，近4天胸痛减轻，感胸闷气促。查体：右下胸语音震颤减弱，叩浊，呼吸音降低。诊断最可能是
A. 肺炎链球菌肺炎
B. 支原体肺炎
C. 结核性胸膜炎
D. 浸润型肺结核
E. 支气管肺癌

正确答案：C。结核性胸膜炎

解析：患者为中年男性，多年吸烟史，近2周有发热（低热），右胸疼痛，后胸痛减轻，感胸闷气促，右下胸语音震颤减弱，叩诊浊音，呼吸音降低（提示胸腔积液），根据其临床表现和体征，考虑诊断为结核性胸膜炎（C对）。肺炎链球菌肺炎（P45）（A错）通常急骤起病，以高热、寒战、咳嗽、血痰及胸痛为特征，体温在数小时内升至39～40℃，痰少，可带血或呈铁锈色，肺实变时，叩诊浊音，语颤增强。支原体肺炎（P49）（B错）多为阵发性刺激性呛咳，主要有乏力、咽痛、头痛、咳嗽、发热、食欲不振、腹泻、肌痛、耳痛等，肺部体检可无明显体征。浸润型肺结核（P68）（D错）多发生在肺尖和锁骨下，只有病灶累及胸膜时才出现胸痛，并不会一开始就有胸痛的症状，影像学检查表现为小片状或斑点状阴影，可融合和形成空洞。支气管肺癌（P77）（E错）起病缓慢，病程较长，咳嗽为早期症状，常为无痰或少痰的刺激性干咳，当肿瘤引起支气管狭窄后可加重咳嗽，多为持续性，呈高调金属音性咳嗽或刺激性呛咳。